肾是泌尿系统功能的主要执行者。位于腹膜后，其周围有被膜保护，具有产生尿液及重要的内分泌功能。肾蒂内主要结构的位置排列关系，由前向后依次是
A. 肾动脉、肾静脉、肾盂
B. 肾盂、肾静脉、肾动脉
C. 肾盂、肾动脉、肾静脉
D. 肾静脉、肾动脉、肾盂
E. 肾静脉、肾盂、肾动脉

正确答案：D。肾静脉、肾动脉、肾盂

解析：肾蒂内主要结构的位置排列关系，由前向后依次是肾静脉、肾动脉、肾盂（D对）。